局麻药的作用机制是
A. 在神经膜内侧阻断K⁺内流
B. 在神经膜内侧阻断Na⁺内流
C. 在神经膜内侧阻断Ca²⁺内流
D. 在神经膜内侧阻断Cl⁻内流
E. 降低静息膜电位

正确答案：B。在神经膜内侧阻断Na⁺内流